关于牙根纵裂描述正确的是
A. 患者多为青年人
B. 多见于前牙
C. 临床检查易发现
D. 无髓牙不易纵裂
E. 裂片可发生移动

正确答案：E。裂片可发生移动

解析：牙根纵裂是指发生在牙根的纵行裂开。患者多为中老年人，牙位以前磨牙和磨牙多见，症状有不同程度的咬合痛，反复出现的牙根脓肿等。因破坏发生在深部的牙根，临床检查不宜发现。X线检查可见纵裂处影像边缘整齐，通过根尖孔。早期根裂方向与根管长轴一致，发生时间较长者，裂片会发生移动。无髓牙会因脱水而变脆，受力时易发生纵裂。掌握“牙根纵裂”知识点。